有关颈总动脉的描述，错误的是
A. 是头颈部的主要供血动脉
B. 左、右各一条
C. 左、右颈总动脉均直接起于主动脉弓
D. 约在甲状软骨上缘分为颈内、外动脉
E. 是颈动脉鞘的内容之一

正确答案：C。左、右颈总动脉均直接起于主动脉弓

解析：颈总动脉是头颈部的主要供血动脉（A对）。左、右各一条（B对）。左颈总动脉起自主动脉弓，右颈总动脉起自头臂干（C错，为本题正确答案）。至甲状软骨上缘的高度，分为颈内动脉和颈外动脉（D对）。是颈动脉鞘的内容之一（E对）。